培养于44.5±0.2℃的温水浴内能生长繁殖使乳糖发酵而产酸产气的大肠菌群细菌，称为
A. 总大肠菌群
B. 自然环境中的大肠菌群
C. 粪大肠菌群
D. 大肠菌群
E. 畜、禽粪便大肠菌群

正确答案：C。粪大肠菌群

解析：本题考查粪大肠菌群。粪大肠菌群（C对ABDE错）是一群在44.5℃培养24小时，能使乳糖发酵产酸产气的细菌。它来源于人和温血动物粪便，是判断饮用水是否受粪便污染的重要微生物指标。